属于宫颈癌ⅢA的表现为
A. 癌浸润膀胱黏膜或直肠黏膜
B. 可见癌灶最大直径＞4cm
C. 临床可见癌灶最大直径≤4cm
D. 肿瘤累及阴道下1/3，但未达盆壁
E. 癌灶已超出宫颈，但未达盆壁。癌累及阴道，但未达阴道下1/3

正确答案：D。肿瘤累及阴道下1/3，但未达盆壁

解析：ⅢA：肿瘤累及阴道下1/3，但未达盆壁。ⅢB：肿瘤浸润宫旁为主，已达盆壁，或有肾盂积水或肾无功能者。掌握“宫颈癌”知识点。